男，60岁。水肿、蛋白尿3个月。既往患糖尿病3年，高血压2年，实验室检查：ESR43mm/h，Hb80g/L，TP79g/L，AIb30g/L，SCr152µmoI/L。尿沉渣镜检RBC0~2/HP，尿蛋白（＋）。尿蛋白定量7.6g/24h，尿蛋白分析提示以小分子蛋白为主。应首先做的检查是
A. 抗中性粒细胞胞浆抗体
B. 骨髓穿刺、血尿免疫固定电泳
C. 乙肝病毒标志物
D. 双肾B超
E. 肾穿刺活检

正确答案：B。骨髓穿刺、血尿免疫固定电泳

解析：老年男性患者，既往高血压，水肿、蛋白尿，ESR加快，Hb减少（贫血），TP（总蛋白）增多，AIb（白蛋白）减少，SCr增多，尿蛋白（＋），尿蛋白定量7.6g/24h，以小分子蛋白（本周蛋白）为主。该患者最可能的诊断是多发性骨髓瘤肾损害。应首先做的检查是骨髓穿刺、血尿免疫固定电泳（B对）。骨髓中浆细胞异常增生，并伴有质的改变。骨髓瘤细胞大小形态不一，成堆出现，核内可见核仁1-4个，并可见双核或多核浆细胞。血清蛋白电泳可见一染色浓而密集、单峰突起的M蛋白，正常免疫球蛋白减少。尿免疫固定电泳可见约半数病人中出现本周蛋白。